患者，男，60岁。呛咳少痰，气短自汗，口干舌燥，苔薄少津，脉虚数，证属久咳肺虚，气阴两伤。治疗应首选
A. 天王补心丹
B. 四物汤
C. 酸枣仁汤
D. 生脉散
E. 朱砂安神丸

正确答案：D。生脉散

解析：本题考查常见的病症的辩证、处方。题中患者呛咳少痰，气短自汗，口干舌燥，苔薄少津，脉虚数，证属久咳肺虚，气阴两伤,可辨证为久咳伤肺，气阴两虚证。天王补心丹为安神剂, 具有滋阴清热，养血安神之功效。主治阴虚血少，神志不安证。心悸怔忡，虚烦失眠，神疲健忘，或梦遗，手足心热，口舌生疮，大便干结，舌红少苔，脉细数（A错）。四物汤主治营血虚滞证。心悸失眠，头晕目眩，面色无华，妇人月经不调，经量少或闭经，表现为舌淡，脉细弦或细涩（B错）。酸枣仁汤为安神剂，具有养血安神，清热除烦之功效。主治肝血不足，虚热内扰证。虚烦失眠，心悸不安，头目眩晕，咽干口燥，舌红，脉弦细（C错）。生脉散为补益剂，具有益气生津，敛阴止汗之功效。主治温热、暑热、耗气伤阴证；久咳伤肺，气阴两虚证（D对）。朱砂安神丸为安神剂，具有镇心安神，清热养血之功效。主治心火亢盛，阴血不足证。失眠多梦，惊悸怔忡，心烦神乱：或胸中懊侬，舌尖红，脉细数（E错）。